预防急性肾功能衰竭
A. 呋塞米
B. 乙酰唑胺
C. 氢氯噻嗪
D. 螺内酯
E. 氨苯蝶啶

正确答案：C。氢氯噻嗪